化脓灸所属的灸法是
A. 直接灸
B. 间接灸
C. 悬起灸
D. 实按灸
E. 天灸

正确答案：A。直接灸

解析：艾灸法分为艾炷灸、艾条灸、温针灸和温灸器灸。艾炷灸分为直接灸和间接灸。直接灸又分为瘢痕灸和无瘢痕灸，化脓灸即为瘢痕灸（A对）。